假设某疾病只有两个充分病因，第一个充分病因包括A、B、C、D这4个组分病因，第二个充分病因包括A、E、F、G这4个组分病因，这两个充分病因所导致的病例分别占40%和60%，则A的归因危险度百分比为
A. 0.25
B. 0.4
C. 0.5
D. 0.6
E. 1

正确答案：E。1

解析：本题考查充分病因和组分病因。由于该疾病两个充分病因都包括A这个组分病因，故A的归因危险度百分比为100%（E对ABCD错）。